医德修养的主要内容是指
A. 卫生部长提出的要求
B. 医院院长提出的要求
C. 病人提出的要求
D. 新闻媒体提出的要求
E. 医德原则规范提出的要求

正确答案：E。医德原则规范提出的要求

解析：医德修养是医务人员一项重要的医德实践活动，是医务人员通过自我教育、自我磨炼，把社会主义医德基本原则的规范转化为个人医德品质的过程。医德修养的主要内容包括医德理论修养、医德情感修养和医德智慧修养，这些内容是医德原则规范提出的要求（E对），而不是具体的卫生部长（A错）、医院院长（B错）、病人（C错）或是新闻媒体（D错）提出的要求。